肉桂的功效是
A. 温中降逆
B. 温通经脉
C. 温经止血
D. 温肺化饮
E. 温中杀虫

正确答案：B。温通经脉